被动转运包括
A. 简单扩散
B. 异化扩散
C. 膜动转运
D. A、B、C都是
E. A、B、C都不是

正确答案：A。简单扩散